器官移植后排异反应可选用的药物是
A. 左旋咪唑
B. 氯米芬
C. 环孢素
D. 干扰素
E. 垂体后叶素

正确答案：C。环孢素

解析：本题考查环孢素的临床应用。环孢素（C对）首选用于抑制器官和组织移植后的排异反应，在肾移植和骨髓移植上用的最多。